栀子不具有的功效是
A. 泻火除烦
B. 清热利尿
C. 凉血解毒
D. 消痰化瘀
E. 消肿止痛

正确答案：D。消痰化瘀

解析：本题考查的是栀子的功效。栀子不具有的功效是消痰化瘀（D错，为本题正确答案）。栀子：【功效】泻火除烦（A对），清热利尿（B对），凉血解毒（C对），消肿止痛（E对）。消痰化瘀为瓦楞子的功效。瓦楞子：【功效】消痰化瘀，软坚散结，制酸止痛。